正确描述直窦的是
A. 由下矢状窦和岩上窦汇合而成
B. 位于大脑镰游离缘中
C. 由下矢状窦和大脑大静脉汇合而成
D. 行于小脑幕游离缘中
E. 以上都不对

正确答案：C。由下矢状窦和大脑大静脉汇合而成

解析：直窦位于大脑镰与小脑幕连接处，由下矢状窦和大脑大静脉汇合而成（C对），向后通窦汇。